根据《药品说明书和标签管理规定》对于横版标签，药品通用名必须在上范围内显著标出
A. 1∕5
B. 1∕4
C. 1∕3
D. 1∕2
E. 2∕3

正确答案：C。1∕3

解析：本题考查药品通用名称。根据《药品说明书和标签管理规定》对于横版标签，药品通用名必须在上范围内显著标出1∕3（C对）。药品通用名称应当显著、突出，其字体、字号和颜色必须符合：①对于横版标签，必须在上三分之一范围内显著位置标出；对于竖版标签，必须在右三分之一范围内显著位置标出；除因包装尺寸的限制而无法同行书写的，不得分行书写。②不得选用草书、篆书等不易识别的字体，不得使用斜体、中空、阴影等形式对字体进行修饰。③字体颜色应当使用黑色或者白色，不得使用其他颜色。浅黑、灰黑、亮白、乳白等黑、白色号均可使用，但要与其背景形成强烈反差的要求。